对于张嘴困难的残疾儿童，可帮助其开口的器械为
A. 冲牙器
B. 牙线
C. 压舌板
D. （牙合）垫
E. 菌斑显示剂

正确答案：C。压舌板

解析：对于张嘴困难的残疾儿童，可用纱布缠住几块压舌板放在上下牙列之间，以便于帮助者进行操作。对于刷牙清洁不到的牙面，应考虑使用牙线，也可借助菌斑显示剂来检查刷牙的效果。掌握“残疾人口腔保健”知识点。